属于第二代头孢菌素的药物是
A. 头孢氨苄
B. 头孢哌酮
C. 头孢吡肟
D. 头孢拉定
E. 头孢呋辛

正确答案：E。头孢呋辛

解析：本题考查头孢菌素的分类。头孢呋辛（E对）属于第二代头孢菌素。第一代头孢菌素主要作用于需氧革兰阳性球菌，常用品种有头孢唑林和头孢拉定注射剂，口服制剂头孢拉定（D错）、头孢氨苄（A错）和头孢羟氨苄等。第二代头孢菌素对革兰阳性球菌的活性与第一代头孢菌素相仿或略差，对部分肠杆菌科细菌亦具有抗菌活性。常用的注射剂有头孢呋辛和头孢替安，口服制剂有头孢克洛、头孢呋辛酯和头孢丙烯等。第三代头孢菌素对肠杆菌科细菌有良好的抗菌作用，注射品种有头孢噻肟、头孢曲松、头孢他啶和头孢哌酮（B错）等。口服制剂有头孢克肟、头孢泊肟酯等。第四代头孢菌素常用者为头孢吡肟（C错），对肠杆菌科细菌和铜绿假单胞菌的活性与头孢他啶大致相仿；但对产AmpC酶的阴沟肠杆菌、产气肠杆菌、柠檬酸杆菌和沙雷菌属的作用优于头孢他啶等第三代头孢菌素。第五代头孢菌素代表药有头孢洛林酯、头孢托罗、头孢吡普等。